下列药物配伍或联用时，发生的现象属于物理配伍变化的是
A. 氯霉素注射液加入5%葡萄糖注射液中析岀
B. 多巴胺注射液与碳酸氢钠注射液配伍后，溶液逐渐变成粉红至紫色
C. 阿莫西林与克拉维酸钾制成复方制剂时抗菌疗效最强
D. 维生素B₁₂注射液与维生素C注射液配伍时效价最低
E. 甲氧苄啶与磺胺类药物制成复方制剂时抗菌疗效最强

正确答案：A。氯霉素注射液加入5%葡萄糖注射液中析岀

解析：本题考查药物的配伍变化。下列药物配伍或联用时，发生的现象属于物理配伍变化的是氯霉素注射液加入5%葡萄糖注射液中析岀（A对）。氯霉素注射液中含有丙二醇，在水中溶解度很小（1：400），加入5%葡萄糖注射液中时往往析出氯霉素，属于物理学配伍变化；多巴胺注射液与碳酸氢钠注射液配伍会渐变成粉红至红色（B错）属于化学配伍变化；阿莫西林与克拉维酸钾制成复方制剂时抗菌疗效最强（C错）属于药理学配伍变化；维生素B₁₂与Vc合用，B₁₂的效价显著降低（D错）属于药物化学配伍变化；甲氧苄啶与磺胺类药物制成复方制剂时抗菌疗效最强（E错）属于药理学配伍变化。